慢性缺氧可使红细胞数及血红蛋白量明显增加的主要机制是
A. 刺激肝脏，使促红细胞生成素增加
B. 增强促红细胞生成素对骨髓的生理效应
C. 抑制肝、脾对红细胞的破坏
D. 交感神经兴奋，肝、脾储血库收缩
E. 肾脏生成和释放促红细胞生成素增多

正确答案：E。肾脏生成和释放促红细胞生成素增多

解析：慢性缺氧时，肾脏生成和释放促红细胞生成素（EPO）增多（E对）。EPO主要通过调节红系的增生和分化、抑制原红细胞和早幼红细胞凋亡等途径，使红细胞生成增加。刺激肝脏，使促红细胞生成素增加（A错）、增强促红细胞生成素对骨髓的生理效应（B错）、抑制肝、脾对红细胞的破坏（C错）、交感神经兴奋，肝、脾储血库收缩（D错）都不是慢性缺氧使红细胞数及血红蛋白量明显增加的主要机制。